牙髓充血、软组织水肿、中性粒细胞形成，是什么
A. 急性牙髓炎化脓期
B. 急性牙髓炎浆液期
C. 慢性闭锁性牙髓炎
D. 慢性溃疡性牙髓炎
E. 慢性增生性牙髓炎

正确答案：B。急性牙髓炎浆液期

解析：本题考查急性牙髓炎。牙髓充血、软组织水肿、中性性粒细胞形成，是急性牙髓炎浆液期（B对）。急性浆液性牙髓炎：早期病变局限在受刺激部位相对应的牙髓，如龋损下方，牙髓血管扩张充血，血管通透性增加，液体渗出，组织水肿，沿血管壁周围有纤维蛋白渗出。急性化脓性牙髓炎（A错）：急性牙髓炎处于浆液期时，若炎性渗出未得到及时引流，髓腔压力极度增加，最终使整个牙髓液化坏死，此时称为急性化脓性牙髓炎。慢性闭锁性牙髓炎（C错）：镜下可见牙髓血管扩张充血，组织水肿，淋巴细胞、浆细胞、巨噬细胞、中性粒细胞浸润，同时可伴有毛细血管和成纤维细胞增生，肉芽组织形成。慢性溃疡性牙髓炎（D错）：镜下观察，溃疡表面有食物残屑、炎性渗出物及坏死组织覆盖，有时可见钙化物沉积，其下方为炎性肉芽组织和一些新生的胶原纤维。深部存活牙髓组织有散在淋巴细胞、浆细胞浸润。慢性增生性牙髓炎（E错）：主要表现为慢性炎症性的牙髓组织过度增生，其增生物又称牙髓息肉。